小儿体格发育的两个高峰时期是
A. 学龄期、学龄前期
B. 学龄期、青春期
C. 青春期、幼儿期
D. 学龄期、新生儿期
E. 青春期、婴儿期

正确答案：E。青春期、婴儿期

解析：青春期又称为少年期，中学学龄期，从第二性征出现到生殖功能基本发育成熟、身高停止增长的时期称为青春期。身高增长显著加速，是第二个体格生长高峰。婴儿期是小儿生长发育最迅速的时期，身长在一年中增长50%，体重增加2倍。掌握“小儿年龄分期”知识点。